扩张脑血管作用较强，能增加脑血流量的钙通道阻滞剂是
A. 氨氯地平
B. 拉西地平
C. 非洛地平
D. 尼莫地平
E. 硝苯地平

正确答案：D。尼莫地平

解析：本题考查钙通道阻滞剂的作用特点。氨氯地平、拉西地平、非洛地平、尼莫地平、硝苯地平都属于钙通道阻滞剂，其中尼莫地平（D对）舒张脑血管作用较强，能增加脑血流量。